某女，34岁。恶寒发热，无汗，喘咳，痰多而稀，鼻塞流涕；舌苔白滑，脉浮滑。诊断为喘证，证属风寒闭肺，宜选用的中成药是
A. 清肺消炎丸
B. 养阴清肺膏
C. 小青龙胶囊
D. 橘红痰咳颗粒
E. 参茸黑锡丸

正确答案：C。小青龙胶囊

解析：本题考查喘证之风寒闭肺证的中成药应用。诊断为喘证，证属风寒闭肺，宜选用的中成药是小青龙胶囊（C对）。喘证之风寒闭肺证【症状】喘咳气逆，呼吸急促，胸部胀闷，痰多色白稀薄而带泡沫，兼头痛鼻塞、无汗、恶寒、发热，舌苔薄白而滑，脉浮紧。【中成药应用】小青龙胶囊、风寒咳嗽颗粒、苓桂咳喘宁胶囊、桂龙咳喘宁胶囊。喘证之痰热壅肺证【症状】喘咳气涌，胸部胀痛，痰稠黏色黄，或夹血痰，伴胸中烦闷、身热、有汗、口渴喜冷饮、咽干、面红、尿赤、便秘。舌质红，苔薄黄腻，脉滑数。【中成药应用】清肺消炎丸（A错）、葶贝胶囊。咳嗽之肺阴亏耗证【症状】咳嗽日久，干咳少痰，或痰中带血，午后咳甚，或伴五心烦热，额红，耳鸣，消瘦，神疲。舌质红，苔少，脉细数。【中成药应用】养阴清肺膏（B错）、百合固金丸、二冬膏。喘证之痰浊阻肺证【症状】喘而胸满闷塞，甚则胸盈仰息，咳嗽，痰多黏腻色白，咳吐不利，兼有呕恶，食少，口黏不渴。舌苔白腻，脉滑或濡。【中成药应用】橘红痰咳颗粒（D错）、祛痰止咳颗粒。肺涨之肺肾气虚证【症状】胸部膨满，呼吸浅短难续，声低气怯，甚则张口抬肩，不能平卧，咳嗽，痰白如沫，咳吐不利，胸闷心慌，形寒汗出，腰膝酸软，小便清长，或尿有余沥。舌淡或暗紫，脉沉细无力，或结、代。【中成药应用】参茸黑锡丸（E错）、百令胶囊。